慢性非特异性唇炎的临床表现为
A. 皲裂
B. 脱屑
C. 结痂
D. 水肿
E. 以上都是

正确答案：E。以上都是

解析：本题考查慢性非特异性唇炎的临床表现。慢性非特异性唇炎按临床表现特点可分为以脱屑为主的慢性脱屑性唇炎和以渗出糜烂为主的慢性糜烂性唇炎。1.慢性脱屑性唇炎唇红部干燥、开裂，有黄白色或褐色脱屑（B对），有继发感染时呈轻度水肿（D对）充血，局部干胀、发痒、刺痛或灼痛，病情反反复复，可持续数月甚至数年不愈；2.慢性糜烂性唇炎上下唇红部反复糜烂，渗出明显，结痂（C对）剥脱，有炎性渗出物时会形成黄色薄痂，有出血时会凝结血痂，有继发感染时会结为脓痂，痂皮脱落后形成出血性创面，灼热疼痛，或发胀发痒，患者常不自觉咬唇，舔舌或用手揉擦，以致病损部位皲裂（A对），疼痛加重，渗出愈加明显，继之又结痂，造成痂上叠痂，唇红部肿胀或慢性轻度增生，下颌下淋巴结肿大，患部可有暂时愈合，但常复发。综上所述，以上均正确(E对，为本题正确答案)。